异烟肼合用香豆素类药物抗凝血作用增强属于
A. 药理学的配伍变化
B. 给药途径的变化
C. 适应证的变化
D. 物理学的配伍变化
E. 化学的配伍变化

正确答案：A。药理学的配伍变化

解析：本题考查药物的配伍变化。异烟肼合用香豆素类药物抗凝血作用增强属于药理学的配伍变化（A对）。药理学的配伍变化：（1）协同作用；（2）拮抗作用；（3）增加毒副作用。此例为协同作用，属于药理学的配伍变化。